女，30。产后高热，体温39.3℃。无咳嗽、咳痰。查体：心肺无明显异常。血常规：Hb104g/L，WBC8.9×10⁹/L，N0.74。胸部X线片大致正常。静脉滴注多种抗生素治疗2周无效。复查胸部X线片示：双肺弥漫分布直径约2mm的小结节影。该患者最可能的诊断是
A. 绒毛膜癌肺转移
B. 血行播散型肺结核
C. 结节病
D. 白血病肺浸润
E. 过敏性肺炎

正确答案：B。血行播散型肺结核

解析：患者高热，X线片示：双肺弥漫分布直径约2mm的小结节影。该患者最可能的诊断是血行播散型肺结核（B对）。绒毛膜癌肺转移（A错）有HCG升高。结节病（C错）特征性病理改变是非干酪样上皮样细胞性肉芽肿，胸部X线检查：双侧肺门淋巴结肿大（BHL）（伴或不伴右侧气管旁淋巴结肿大）是最常见的征象。白血病肺浸润（D错）有明显出血。过敏性肺炎（E错）多有环境抗原暴露史（如饲养鸽子、鹦鹉等），BAL细胞分析显示淋巴细胞比例增加（P96）。